关于湿度加速试验中临界相对湿度（CRH）的叙述，正确的是
A. 从吸湿平衡图上不能求得药物的CRH
B. CRH愈大，制剂引湿性愈小
C. 中药全浸膏制剂的CRH都较大
D. 添加适量引湿性小的辅料可减小中药全浸膏制剂的CRH
E. 所有中药制剂稳定性考察均需测定其CRH

正确答案：B。CRH愈大，制剂引湿性愈小